龋病的发生要求有口腔致龋菌群以及致龋的食物，有足够的时间共同作用于对龋病敏感的宿主，属于以下哪种学说
A. 蛋白溶解学说
B. 蛋白溶解-螯合学说
C. 广义龋病生态学假说
D. 龋病病因的四联因素理论
E. 化学细菌学说

正确答案：D。龋病病因的四联因素理论

解析：本题考查龋病病因学说。龋病的发生要求有口腔致龋菌群以及致龋的食物，有足够的时间共同作用于对龋病敏感的宿主，属于龋病病因的四联因素理论（D对）。蛋白溶解学说（A错）认为龋病是蛋白溶解，牙釉质有机基质的溶解和液化，牙齿有机结构破坏，无机质崩解的结果。蛋白溶解-螯合学说（B错）认为蛋白溶解-螯合是一种生物学现象，口腔细菌首先分解牙釉质有机成分，破坏后的有机产物具有鳌合特性，溶解牙釉质的矿物成分，最后使牙釉质的有机成分和无机结构同时破坏。广义龋病生态学假说（C错）认为，健康状态下，牙菌斑生物膜内细菌维持着生理动态平衡，不发生龋病；当局部、全身、环境等因素改变，口腔微生态失衡，PH持续降低至临界PH（5.5）以下，牙体硬组织脱矿/再矿化的平衡破坏，导致牙体硬组织持续脱矿，形成肉眼可见的龋洞。化学细菌学说（E错）第一次将牙齿-细菌-碳水化合物与龋病联系起来，口腔细菌代谢碳水化合物，产生有机酸使牙釉质脱矿，酸也可以沿牙本质小管进入，造成牙本质脱矿，细菌产生的蛋白溶解酶溶解牙本质有机质，使牙本质崩溃，形成龋洞。